5岁儿童的头围约是
A. 36cm
B. 40cm
C. 46cm
D. 50cm
E. 56cm

正确答案：D。50cm

解析：婴儿出生时头围平均33-34cm（AB错），1岁时头围46cm（C错）。生后第2年头围仅增长2cm，即2岁时头围48cm。2～15岁头围仅增加6～7cm（E错）。5岁时头围约为50cm（D对）。